与绝经综合征内分泌相关，不正确的是
A. AMH下降
B. 孕酮下降
C. 雌激素波动大
D. GnRH下降
E. FSH明显升高

正确答案：D。GnRH下降

解析：AMH是抗米勒管激素，用于评估卵巢储备功能，预测COS反应和预测更年期，绝经后，抗米勒管激素水平下降，较FSH升高、雌二醇下降早，能较早反映卵巢功能衰退（A对）。绝经后无孕酮分泌（B对）。绝经过渡早期雌激素水平波动很大”（C对）。绝经过渡期FSH水平升高，呈波动型（E对）。